男性，25岁。烧伤后2小时入院，Ⅱ°烧伤面积共约40%，体重约60公斤。第一个24个小时，应输入的液体总量约为
A. 2400ml
B. 3400ml
C. 4600ml
D. 5600ml
E. 6500ml

正确答案：D。5600ml

解析：正常成年人烧伤后第一个24个小时，每1%Ⅱ°、Ⅲ°烧伤面积每公斤体重补充胶体液0.5ml和电解质液1ml，总计1.5ml/kg。该25岁男性病人，Ⅱ°烧伤面积共约40%、体重约60公斤，因此该病人第一个24个小时，应输入的液体总量约为60×40×1.5+2000＝5600ml（D对）。其中一半液体于伤后前8小时内输入，另一半液体在后16小时补入。